湿邪的性质和致病特点有
A. 重浊
B. 黏腻
C. 易袭阴位
D. 易困脾气
E. 易阻遏气机

正确答案：A、B、C、D、E。重浊；黏腻；易袭阴位；易困脾气；易阻遏气机

解析：本题考查的是湿邪的性质和致病特点。湿邪的性质和致病特点有重浊（A对）、黏腻（B对）、易袭阴位（C对）、易困脾气（D对）与易阻遏气机（E对）。湿邪的性质及致病特点。（1）湿为阴邪，易阻遏气机，损伤阳气：湿邪侵及人体，留滞于脏腑经络，最易阻遏气机，使气机升降失常，经络阻滞不畅，常可出现胸闷脘痞、小便短涩、大便不爽等症状。此外，湿为阴邪，易损伤阳气。脾主运化水湿，其性喜燥而恶湿，故外感湿邪，留滞体内，常先困脾气，使脾阳不振，运化水湿功能减弱，水湿停聚，出现腹泻、尿少、水肿、腹水等病证。（2）湿性重浊：“重”，即沉重或重着之意。感受湿邪，常可见头重如裹、周身困重、四肢酸懒沉重等症状。若湿邪留滞经络关节，则阳气输布受阻，故见肌肤不仁、关节疼痛重着等，又称“湿痹”或“着痹”。“浊”，即秽浊不清，多指分泌物和排泄物秽浊不清而言。临床症状多见面垢眵多、大便溏泻、下利黏液脓血、小便浑浊、妇女白带过多、湿疹浸淫流水等，都是湿邪秽浊的表现。（3）湿性黏滞：“黏”，即黏腻，“滞”，即停滞。湿邪黏腻停滞，主要表现在两个方面：一是指湿邪致病临床表现多黏滞不爽，如排出物及分泌物多滞涩而不畅；二是指湿邪为病多缠绵难愈，病程较长或反复发作。如湿温、湿痹、湿疹等病，皆因湿邪难以祛除而不易速愈。（4）湿性趋下，易伤阴位：湿邪伤人，其病多见于下部，如下肢水肿明显。此外，淋浊、带下、泄利等病证，亦多由湿邪下注所致。